通过竞争性抑制α-葡萄糖苷酶的活性，减慢淀粉等多糖分解为双糖和单糖，延缓单糖的吸收，主要降餐后血糖的口服降糖药的是
A. 恩格列净
B. 吡格列酮
C. 阿格列汀
D. 格列喹酮
E. 米格列醇

正确答案：E。米格列醇

解析：本题考查口服降糖药。米格列醇（E对）为α-葡萄糖苷酶抑制剂，在缓解糖尿病患者餐后高血糖方面优于磺酰脲类药，使血糖高峰与低谷间距缩短，适用于糖耐量（IGT）异常阶段、早期、以碳水化合物为主要食物成分和餐后血糖升高为主的糖尿病患者。